视诊能观察到患者的全身一般状态和许多全身或局部的体征，除了
A. 年龄段
B. 发育、营养
C. 肝脏肿大
D. 表情
E. 体位及步态

正确答案：C。肝脏肿大

解析：视诊是医师用眼睛观察病人全身或局部表现的诊断方法。视诊可用于全身一般状态和许多体征的检查，如年龄段（A对）、发育、营养（B对）、意识状态、面容、表情（D对）、体位、姿势、步态（E对）等。局部视诊可了解病人身体各部分的改变，如皮肤、黏膜、眼、耳、鼻、口、舌、头颈、胸廓、腹形、肌肉、骨骼、关节外形等。特殊部位的视诊需借助于某些仪器，如耳镜、鼻镜、检眼镜及内镜等进行检查，而肝脏肿大（C错，为本题正确答案）是触诊和叩诊的内容。